具有软坚泻下功效的药物是
A. 大黄
B. 芒硝
C. 巴豆
D. 甘遂
E. 牵牛子

正确答案：B。芒硝

解析：该题考查芒硝的功效，属记忆内容。芒硝味咸、苦，性寒；入胃、大肠经；具有泻下攻积，润燥软坚，清热消肿的功效（B对ACDE错）。